水浸液在日光下即可显碧蓝色荧光的药材是
A. 秦皮
B. 香加皮
C. 合欢皮
D. 桑白皮
E. 地骨皮

正确答案：A。秦皮

解析：本题考查的是秦皮的性状鉴别。水浸液在日光下即可显碧蓝色荧光的药材是秦皮（A对）。秦皮【性状鉴别】饮片呈长短不一的丝条状。外表面灰白色、灰棕色或黑棕色。内表面黄白色或棕色，平滑。切面纤维性。质硬。气微，味苦。本品热水浸出液呈黄绿色，日光下显碧蓝色荧光。香加皮（B错）【性状鉴别】饮片呈不规则的厚片。外表面灰棕色或黄棕色，栓皮常呈鳞片状。内表面淡黄色或淡黄棕色，有细纵纹。切断面黄白色。有特异香气，味苦。合欢皮（C错）【性状鉴别】饮片呈弯曲的丝或块片状。外表面灰棕色至灰褐色，稍有纵皱纹，密生明显的椭圆形横向皮孔，棕色或棕红色。内表面淡黄棕色或黄白色，平滑，具细密纵纹。切面呈纤维性片状，淡黄棕色或黄白色。气微香，味淡、微涩、稍刺舌，而后喉头有不适感。桑白皮（D错）【性状鉴别】饮片呈丝条状，外表面白色或淡黄白色，有的残留橙黄色或棕黄色鳞片状粗皮；内表面黄白色或灰黄色，有细纵纹。体轻，质韧，纤维性强。气微，味微甘。地骨皮（E错）【性状鉴别】药材呈筒状或槽状。外表面灰黄色至棕黄色，粗糙，有不规则纵裂纹，易成鳞片状剥落。内表面黄白色至灰黄色，较平坦，有细纵纹。体轻，质脆，易折断，断面不平坦，外层黄棕色，内层灰白色。气微，味微甘而后苦。以块大、肉厚、无木心者为佳。